根据2013年1月发布的《药品经营质量管理规范》，药品批发企业对实施批签发管理的生物制品的验收要求是
A. 应当至少检査一个最小包装
B. 应当开箱检验至直接接触药品的包装
C. 应当检查箱内的所有最小包装
D. 可不打开最小包装
E. 可不开箱检查

正确答案：E。可不开箱检查

解析：本题考查的是药品批发企业药品收货与验收。《药品经营质量管理规范》，药品批发企业对每次到货药品进行抽样验收的要求是生产企业有特殊质量控制要求的药品可不打开最小包装（E对）。药品批发企业药品验收抽样：企业应当对每次到货的药品进行逐批抽样验收，抽取的样品应当具有代表性：同一批号的药品应当至少检查一个最小包装（D错），但生产企业有特殊质量控制要求或者打开最小包装可能影响药品质量的，可不打开最小包装；破损、污染、渗液、封条损坏等包装异常以及零货、拼箱的，应当开箱检查至最小包装；外包装及封签完整的原料药、实施批签发管理的生物制品，可不开箱检查（B错）。验收人员应当对抽样药品的外观、包装、标签、说明书以及相关的证明文件等逐一进行检查、核对；验收结束后，应当将抽取的完好样品放回原包装箱，加封并标示。特殊管理的药品应当按照相关规定在专库或者专区内验收。